符合Ⅱ型呼吸衰竭的动脉血气标准是
A. PaO₂为70mmHg，PaCO₂为45mmHg
B. PaO₂为70mmHg，PaCO₂为40mmHg
C. PaO₂为55mmHg，PaCO₂为60mmHg
D. PaO₂为50mmHg，PaCO₂为40mmHg
E. PaO₂为65mmHg，PaCO₂为40mmHg

正确答案：C。PaO₂为55mmHg，PaCO₂为60mmHg

解析：呼吸衰竭是指各种原因引起的肺通气和（或）换气功能严重障碍，使静息状态下亦不能维持足够的气体交换，导致低氧血症伴（或不伴）高碳酸血症，进而引起一系列病理生理改变和相应临床表现的综合征。呼吸衰竭按照动脉血气分类，可分为I型呼吸衰竭和Ⅱ型呼吸衰竭。其中I型呼吸衰竭即低氧性呼吸衰竭，血气分析特点是PaO₂＜60mmHg，PaCO₂降低或正常（PaCO₂正常值为35～45mmHg）（D错）。PaO₂为70mmHg，PaCO₂为45mmHg（A错）、PaO₂为70mmHg，PaCO₂为40mmHg（B错）、PaO₂为65mmHg，PaCO₂为40mmHg（E错）为正常人的动脉血气分析。PaO₂为55mmHg，PaCO₂为50mmHg（C对ABDE错）为Ⅱ型呼吸衰竭（即高碳酸性呼吸衰竭，血气分析特点是PaO₂＜60mmHg，同时伴有PaCO₂＞50mmHg）。